患者女，进食酸甜食物时左下后牙疼痛不适。诊断为深龋。备洞敏感，龋坏可去尽，未穿髓，处理时应选择
A. 间接盖髓术
B. 直接盖髓术
C. 安抚治疗
D. 垫底充填
E. 牙髓治疗

正确答案：C。安抚治疗

解析：本题考查深龋的治疗。该患者诊断为深龋，备洞敏感，可一次去净龋坏，应该采用安抚治疗（C对）。间接盖髓术（A错）适用于软化牙本质不能一次去净，牙髓-牙本质反应能力下降，无明显主观症状的深龋。直接盖髓术（B错）适用于牙髓暴露而需要或可以保存活髄的患牙。垫底充填（D错）适用于无自发痛，激发痛不明显，刺激去除后无延缓痛，能去净龋坏的患牙。牙髓治疗（E错）即根管治疗，适用于牙髓因各种原因而无保留价值的患牙。